治疗目赤肿痛，除睛明，风池，太阳外，还应选取的主穴是
A. 少商，外关
B. 合谷，太冲
C. 行间，侠溪
D. 内庭，足临泣
E. 关冲，商阳

正确答案：B。合谷，太冲

解析：合谷，太冲为治疗目赤肿痛的主穴（B对）。